慢性龈炎时，自上皮下方的炎症细胞浸润层依次是
A. 淋巴细胞、中性粒细胞
B. 中性粒细胞、淋巴细胞
C. 浆细胞、淋巴细胞
D. 淋巴细胞、巨噬细胞
E. 肥大细胞、中性粒细胞

正确答案：B。中性粒细胞、淋巴细胞

解析：本题考查慢性龈炎的病理变化。慢性龈炎时，自上皮下方的炎症细胞浸润层依次是中性粒细胞、淋巴细胞（B对）。慢性龈炎时，自上皮下方的炎症细胞浸润层依次是中性粒细胞、淋巴结细胞（A错B对）。浆细胞（C错）、巨噬细胞（D错）与肥大细胞（E错）都不是慢性龈炎的主要浸润细胞。